“热深厥亦深”的特点指的是
A. 真虚假实
B. 真实假虚
C. 真寒假热
D. 真热假寒
E. 虚中夹实

正确答案：D。真热假寒

解析：热深厥亦深指人体发热较甚，发热到极点会出现阳热之邪亢盛于力，格拒阴气于外，出现一派假寒之象，属真热假寒症（D对）。真虚假实指病机的本质为“虚”，但表现出“实”的临床假象，又称“至虚有盛候”，如脾气虚弱，运化无力，可见脘腹胀满、疼痛等假实征象（A错）。真实假虚指病机的本质为“实”，但表现出“虚”的临床假象，又称“大实有羸状”，如热结肠胃，一方面出现腹痛硬满拒按，大便秘结，潮热，谵语等症（B错）。真寒假热指阴寒内盛，格阳于外，阴阳寒热格拒而成，又称“阴盛格阳”（C错）。虚中夹实指以正虚为主，又兼有实邪为患的病机变化（E错）。